男，45岁。受凉后畏寒、发热5天，咳嗽、咳黄脓痰，无咯血。既往有糖尿病病史。胸部X线片示右下肺大片实变阴影，入院后症状加重，伴气促，烦躁，四肢湿冷。查体：R34次/分，BP85/50mmHg，右肺呼吸音减弱，可闻及细湿啰音，心率120次/分，未闻及杂音。首先考虑的诊断是
A. 重症肺炎
B. 肺真菌病
C. 急性肺血栓栓塞症
D. 肺结核
E. 肺脓肿

正确答案：A。重症肺炎

解析：患者受凉后畏寒、发热，咳嗽、咳黄脓痰（肺炎常见症状），右肺呼吸音减弱，可闻及细湿罗音，胸部X线片示右下肺大片实变阴影（肺炎常见体征），首先考虑的诊断是肺炎。患者呼吸频率≥30次/分，收缩压<90mmHg或舒张压≤60mmHg，有休克表现，因此诊断为重症肺炎（A对）。肺真菌病（B错）临床表现无特异性，X线影像表现无特征性，可为支气管肺炎、大叶性肺炎、单发或多发结节，乃至肿块状阴影和空洞（P54）。急性肺血栓栓塞症（C错）典型症状为呼吸困难、胸痛及咯血，X线胸片示区域性肺血管纹理减少，有时可见尖端指向肺门的楔形阴影。肺结核（D错）常有低热、盗汗、乏力、消瘦等结核毒性症状，干、湿啰音多局限于上肺（P65）。肺脓肿（E错）起病急，有高热、咳嗽、大量脓臭痰。X线检查可见局部浓密炎症阴影，内有空腔液平（P57）。